根据《药品经营质量管理规范实施细则》，药品零售企业制定的质量管理制度应包括
A. 有关业务和管理岗位的质量责任
B. 服务质量的管理
C. 质量管理人员的考勤
D. 质量信息的管理
E. 卫生和人员健康状况的管理

正确答案：A、B、D、E。有关业务和管理岗位的质量责任；服务质量的管理；质量信息的管理；卫生和人员健康状况的管理

解析：本题考查的是药品零售企业质量管理制度。根据《药品经营质量管理规范实施细则》，药品零售企业制定的质量管理制度应包括有关业务和管理岗位的质量责任（A对）、服务质量的管理（B对）、质量信息的管理（D对）、卫生和人员健康状况的管理（E对）。药品零售企业质量管理制度：药品零售质量管理制度应当包括以下内容：药品采购、验收、陈列、销售等环节的管理，设置库房的还应当包括储存、养护的管理；供货单位和采购品种的审核；处方药销售的管理；药品拆零的管理；特殊管理的药品和国家有专门管理要求的药品的管理；记录和凭证的管理；收集和查询质量信息的管理；质量事故、质量投诉的管理；中药饮片处方审核、调配、核对的管理；药品有效期的管理；不合格药品、药品销毁的管理；环境卫生、人员健康的规定；提供用药咨询、指导合理用药等药学服务的管理；人员培训及考核的规定；药品不良反应报告的规定；计算机系统的管理；药品追溯的规定等